急性化脓性阑尾炎属
A. 蜂窝织炎
B. 脓肿
C. 卡他性炎
D. 纤维素性炎
E. 积脓

正确答案：A。蜂窝织炎

解析：急性化脓性阑尾炎也称急性蜂窝织炎性阑尾炎（A对）。蜂窝织炎是指疏松结缔组织的弥漫性化脓性炎，常发生于皮肤、肌肉和阑尾。脓肿（B错）是指器官或组织内的局限性化脓性炎症，其主要特征是组织发生溶解坏死，形成充满脓液的腔，即脓腔。卡他性炎（C错）以浆液渗出为特征。纤维素性炎（D错）以纤维蛋白原渗出为主。易发生于黏膜、浆膜和肺组织。积脓（E错）指化脓性炎发生于浆膜、胆囊和输卵管并在其管腔中积存。